最常见的甲状腺癌是
A. 乳头状癌
B. 滤泡状癌
C. 髓样癌
D. 梭状细胞癌
E. 巨细胞癌

正确答案：A。乳头状癌

解析：甲状腺癌的主要组织学类型有乳头状癌（A）、滤泡状癌（B）、髓样癌（C）和未分化癌，未分化癌又可分为小细胞癌、梭状细胞癌（D）、巨细胞癌（E）和混合细胞癌。其中乳头状癌（A对）是甲状腺癌中最常见的类型，约占60%。